患者因深龋一次垫底银汞充填后1周出现自发痛，冷热痛持续，不能咬物，其原因最可能为诊断错误，该患牙处理应为
A. 观察
B. 去旧充填物，氧化锌丁香油糊剂安抚
C. 去旧充填物，改其他材料充填
D. 牙髓治疗
E. 去旧充填物，重新垫底，银汞充填

正确答案：D。牙髓治疗

解析：本题考查充填后疼痛的处理。患者有自发痛、冷热痛持续，说明牙髓已有炎症反应，应做牙髓治疗（D对）。观察只会使炎症加重，不可取（A错）。牙髓已有炎症，安抚、垫底及重新充填不能解决病变的发展，且会导致病变进一步加重（BCE错）。